属前体药物，对环氧合酶-2选择性抑制的药物是
A. 舒林酸
B. 萘丁美酮
C. 芬布芬
D. 吡罗昔康
E. 别嘌醇

正确答案：D。吡罗昔康

解析：本题考查吡罗昔康。吡罗昔康（D对）属前体药物，通过抑制环氧合酶-2使组织局部前列腺素的合成减少。舒林酸（A错）在人体内代谢为硫化物，该硫化物可抑制环氧化酶,但作用无选择性；萘丁美酮（B错）为非酸性非甾体抗炎药，对环氧合酶-2无选择性抑制作用；芬布芬（C错）为解热镇痛及非甾体抗炎药，在体内代谢成联苯乙酯，后者可抑制前列腺素的合成，对环氧合酶-2无选择性抑制作用；别嘌醇（E错）是本品及其代谢产物可抑制黄嘌呤氧化酶，进而降低血中尿酸浓度；还可抑制肝药酶的活性，对环氧合酶无作用。